属于正常面部结构关系的一项是
A. 上颌切牙切缘在上唇下缘下约2mm
B. 上颌切牙切缘在上唇下缘下约3mm
C. 下颌前牙与下唇上缘平齐
D. 下颌前牙在下唇上缘下约2mm
E. 下颌前牙在下唇上缘下约3mm

正确答案：C。下颌前牙与下唇上缘平齐

解析：唇齿关系：当下颌位于姿势位时，上颌切牙切缘在上唇下缘下约1mm，下颌前牙与下唇上缘平齐。唇部丰满适度，唇能自然闭合，口角对着上颌尖牙的远中部分或第一前磨牙的近中部分。掌握“（牙合）分类及临床意义与面部结构”知识点。